男，2岁。因舌系带过短拟行舌系带矫正术。在选择局麻药物时，宜使用
A. 利多卡因
B. 布比卡因
C. 阿替卡因
D. 普鲁卡因
E. 丁卡因

正确答案：A。利多卡因

解析：本题考查局麻药。男，2岁。因舌系带过短拟行舌系带矫正术。在选择局麻药物时，宜使用利多卡因（A对）。利多卡因儿童使用时应降低浓度；布比卡因孕妇及儿童慎用（B错）；阿替卡因适用于成人及4岁以上的儿童（C错）；普鲁卡因临床上已很少应用（D错）；丁卡因多用于表面麻醉，避免用于浸润麻醉和阻滞麻醉（E错）。